急性肾炎的临床特征是
A. 大量蛋白尿，低白蛋白血症，高胆固醇血症，明显浮肿
B. 血尿，低白蛋白血症
C. 血尿，水肿，高血压，程度不等的肾功能损害
D. 高血压，大量蛋白尿
E. 高血压，低白蛋白血症

正确答案：C。血尿，水肿，高血压，程度不等的肾功能损害

解析：急性肾炎以血尿为主，伴不同程度的蛋白尿、水肿、高血压或肾功能不全为特点（C对BDE错）。肾病综合征表现为大量蛋白尿，低白蛋白血症，高胆固醇血症，明显浮肿（A错）。